麦冬横切面的显微特征是
A. 表皮细胞1列，根被细胞3～5列，内皮层外侧为1列石细胞
B. 表皮残留，内皮层每一个细胞由纵向壁分隔成数个类方型小细胞。
C. 后生皮层为木栓化细胞，导管单列，径向或略呈“V”字形排列
D. 木栓层偶有石细胞散在，有的木质部中央有栓化细胞环
E. 木栓层为数列细胞，韧皮部和木质部有晶鞘纤维

正确答案：A。表皮细胞1列，根被细胞3～5列，内皮层外侧为1列石细胞